患者将地上的草绳看成一条大蛇，这种表现是
A. 感觉过敏
B. 象征性思维
C. 关系妄想
D. 幻觉
E. 错觉

正确答案：E。错觉

解析：患者把草绳错视为一条大蛇（对客观事物歪曲的知觉）为错觉（E对）。感觉过敏是对刺激的感受性增高，感觉阈值降低，表现为对外界一般强度的刺激产生强烈的感觉体验，如感到阳光特别刺眼、轻柔的音乐特别刺耳等（A错）。象征性思维的患者以无关的具体概念代替某一抽象概念，不经患者本人解释，他人无法理解（B错）。关系妄想的患者认为周围环境中所发生的与自己无关的事情均与自己有关，如认为周围人的谈话时在议论自己（C错）。幻觉是没有现实刺激作用于感觉器官时出现的知觉体验，是一种虚幻的知觉（D错）。